男，45岁。急性黄疸型肝炎患者，经治疗无效，症状渐渐加重。诊断重型肝炎最主要的依据是
A. 血清胆红素明显升高
B. 谷氨酸氨基转移酶升高
C. 凝血酶原活动度小于40%
D. 白细胞升高
E. 血小板降低

正确答案：C。凝血酶原活动度小于40%

解析：诊断重型肝炎最主要的依据是血酶原活动度小于40%（C对）。胆红素是反应肝功能损害严重程度的指标，血清胆红素（A错）升高也有可能是溶血引起，并不能用作诊断重型肝炎最主要的依据。丙氨酸氨基转移酶（ALT）（B错）是目前临床上反应肝细胞功能最常用的指标。白细胞升高（D错）和血小板降低（E错）并不能用来不是用于判断肝功能的指标，不能用来诊断重型肝炎或肝衰竭。